下列关于劣药的说法不正确的是
A. 药品成分的含量不符合国家药品标准的伪劣药
B. 药品成分与国家药品标准规定的成分不符的伪劣药
C. 不注明生产批号的药品按照劣药论处
D. 更改生产批号的药品按照劣药论处
E. 直接接触药品的包装材料和容器未经批准的药品按照劣药论处

正确答案：B。药品成分与国家药品标准规定的成分不符的伪劣药

解析：根据《药品管理法》规定，劣药，是指药品成分含量不符合国家药品标准规定的药品。药品成分与国家药品标准规定的成分不符的药品是假药（B错，为本题正确答案）。